乳头平面主要由下列何神经的前支分布
A. T2
B. T4
C. T6
D. T8
E. 无

正确答案：B。T4

解析：T2（A错）分布区相当于胸骨角平面，T4（B对）相当于乳头平面，T6（C错）相当于剑突平面，T8（D错）相当于两侧肋弓中点连线的平面。